以下不是队列研究主要用途的是
A. 检验病因假说
B. 研究疾病自然史
C. 评价预防措施效果
D. 新药上市前最后一阶段的药物有效性验证
E. 新药上市后监测

正确答案：D。新药上市前最后一阶段的药物有效性验证